患者，女，32岁，诊断为缺铁性贫血，口服硫酸亚铁治疗。药师对该患者进行用药教育时，告知其同用可促进铁剂吸收的是
A. 牛奶
B. 咖啡
C. 肉类
D. 钙剂
E. 茶水

正确答案：C。肉类

解析：本题考查铁剂与食物之间的相互作用。告知其同用可促进铁剂吸收的是肉类（C对）。肉类、果糖、氨基酸、维生素C可促进铁剂吸收。牛奶（A错）、蛋类、钙剂（D错）、磷酸盐等可抑制铁剂吸收。茶（E错）和咖啡（B错）中的鞣质与铁形成不可吸收的盐。铁剂与其它药物之间的相互作用：抑酸药物影响三价铁转化为二价铁，四环素、考来烯胺等阴离子药可在肠道与铁络合，碳酸氢钠可与二价铁生成难溶性碳酸铁，均影响铁剂的吸收。